诊断急性纤维蛋白性心包炎最具有特征性的是
A. 心前区疼痛
B. 心包摩擦音
C. 心浊音界向两侧扩大
D. 心尖搏动减弱或消失
E. 心音遥远

正确答案：B。心包摩擦音

解析：心包摩擦音（B对）为急性纤维蛋白性心包炎最具诊断价值的体征，呈抓刮样粗糙的高频音，多位于心前区，以胸骨左缘第3、4肋间最为明显。心前区疼痛（A错）可出现于急性纤维蛋白性心包炎患者，但也可出现于急性胸膜炎、心绞痛和心肌梗死等患者，不具有特异性。心浊音界向两侧扩大（C错）可见于扩张型心肌病及心包积液等（九版诊断学P147），而急性纤维蛋白性心包炎正处在炎症变化的纤维蛋白渗出期，此时积液量增多不明显，故心浊音界不会向两侧扩大。心尖搏动减弱或消失（D错）可见于引起心肌收缩力下降的疾病如扩张型心肌病和急性心肌梗死等，也可见于心包积液、缩窄性心包炎等（九版诊断学P143），并不具有诊断意义。心音遥远（E错）常见于大量心包积液（P304）。